职业性肿瘤主要多见于
A. 呼吸道
B. 皮肤
C. 膀胱
D. 肝
E. 呼吸道、皮肤及膀胱

正确答案：A。呼吸道